在一种分析性研究中，计算了RR值，可说明暴露因素与发病的关联程度，该指标为
A. 发病率
B. 发病密度
C. 归因危险度
D. 患病率
E. 相对危险度

正确答案：E。相对危险度

解析：根据题意，在分析性研究中，计算RR值来说明暴露因素与发病的关联程度，符合相对危险度的定义（E对）。发病密度是指以观察人时为分母计算发病率，用人时为单位计算出来的率带有瞬时频率（B错）。归因危险度等，是暴露组发病率与非暴露组发病率相差的绝对值，说明危险特异地归因于暴露因素的程度（C错）。